关于糖尿病的营养防治说法正确的是
A. 糖尿病患者应严格一日三餐，不能增减
B. 糖尿病患者应选择高GI的食物
C. 饱和脂肪酸有降血脂和预防动脉粥样硬化的作用
D. 缺锌将使胰岛素合成减少
E. 可溶性膳食纤维将使餐后血糖升高

正确答案：D。缺锌将使胰岛素合成减少

解析：本题考查糖尿病的营养防治。糖尿病患者应合理分配餐次，至少一日三餐，尽量定时、定量（A错）。糖尿病患者应选择低GI的食物（B错），低GI食物可有效控制餐后血糖，有利于血糖的稳定。不饱和脂肪酸有降血脂和预防动脉粥样硬化的作用（C错）。膳食纤维分为可溶性和不溶性两种。可溶性膳食纤维能吸水膨胀，吸附并延缓碳水化合物在消化道的吸收，使餐后血糖和胰岛素水平降低（E错），还有降低胆固醇的作用。不溶性膳食纤维能促进肠蠕动，加快食物通过肠道，减少吸收，具有间接缓解餐后血糖升高和减肥的作用 。锌与胰岛素的合成、分泌、贮存、降解、生物活性及抗原性有关，缺锌时胰腺和β细胞内锌浓度下降，胰岛素合成减少（D对）。